以发现风险、查找隐患为主要目的有一定针对性的监测是
A. 常规监测
B. 专项监测
C. 应急监测
D. 主动监测
E. 被动监测

正确答案：B。专项监测

解析：本题考查专项监测。专项监测（B对ACDE错）是以发现风险、查找隐患为主要目的，可为食品安全监管提供线索，有一定的针对性。